某女青年因咳嗽发热就诊。拍胸片发现右肺有片状阴影，结核菌素试验红肿直径大于2.0cm，试问该患者可能是
A. 机体对结核无免疫能力
B. 结核病恢复期
C. 结核病活动期
D. 注射过卡介苗
E. 结核病早期

正确答案：C。结核病活动期

解析：结核菌素试验结果判定：如果在注射部位出现红肿硬结的范围小于5mm者为阴性；超过5mm者为阳性；≥15mm为强阳性，题目中患者红肿范围大于2cm，属于强阳性的判断，表明此患者处在结核病活动期。掌握“结核、非结核分枝杆菌”知识点。